患者，男，46岁，因支气管哮喘使用布地奈德-福莫特罗粉吸入剂治疗，症状控制良好，4个月内无急性发作，拟进行降级治疗。关于哮喘降级治疗原则的说法，错误的是
A. 以最低剂量的福莫特罗维持治疗，直到最终停药
B. 降级治疗应选择适当时机，需避开患者呼吸道感染等情况
C. 首先减少激素剂量，再减少使用频率
D. 通常每3个月减少布地奈德剂量25%～50%
E. 每一次降级治疗都需要密切观察病情变化，按期随访

正确答案：A。以最低剂量的福莫特罗维持治疗，直到最终停药

解析：本题考查降级治疗。降级推荐的药物减量方案的选择通常是首先减少糖皮质激素用量（口服或吸入），再减少使用次数（如由每日2次减至每日1次）（C对），然后再减去与激素合用的控制药物，以最低剂量ICS维持，直到最终停止治疗（A错，为本题正确答案）。当哮喘症状得到控制并维持至少3个月，且肺功能恢复并维持平稳状态，可考虑降级治疗。降级治疗原则：①哮喘症状控制且肺功能稳定3个月以上，可考虑降级治疗。②降级治疗应选择适当时机，需避开患者呼吸道感染（B对）、妊娠、旅行期等情况。③通常每3个月减少ICS剂量25%～50%（D对）是安全可行的。④每一次降级治疗都应视为一次试验，有可能失败，需要密切观察症状控制情况、PEF变化、危险因素等，并按期随访（E对）；根据症状控制及急性发作的频率进行评估，并告知患者一旦症状恶化，则需恢复原来的治疗方案。